维生素D₃对血液中钙磷浓度的调节作用表现为
A. 降低血钙浓度，升高血磷浓度
B. 升高血钙浓度，降低血磷浓度
C. 升高血钙、血磷浓度
D. 降低血钙浓度，不影响血磷浓度
E. 升高血钙浓度，不影响血磷浓度

正确答案：C。升高血钙、血磷浓度